若不知总体标准差，反映均数抽样误差大小的指标，用
A. S
B. Sx
C. Sp
D. σp
E. σx

正确答案：B。Sx

解析：均数的标准误可以用来表示均数抽样误差的大小，当总体标准差σ未知时，可利用公式S`X= S/√n来计算样本均数标准误S`X，总而得到反映均数抽样误差大小的指标（B对）。